某印染厂男工，45岁，工龄约10年。某日下班后突感到头痛、头晕、口唇及指端发绀，送急诊室就诊。该名工人最可能的诊断应是
A. 二氯乙烷中毒
B. 二氧化氮中毒
C. 苯胺中毒
D. 二甲苯中毒
E. 三硝基甲苯中毒

正确答案：C。苯胺中毒

解析：本题考查苯胺中毒的症状。从事印染行业的工人，处于长期暴露于苯胺（C对ABDE错）的状态。同时长期慢性接触苯胺可出现类神经症，如头晕、头痛、倦乏无力、失眠、记忆力减退、食欲缺乏等症状，并出现轻度发绀、贫血和肝脾肿大等体征。发绀，最先见于口唇、指端及耳垂等部位，其色调与一般缺氧所见的发绀不同，呈蓝灰色，称为化学性发绀。